患者身目发黄，黄色鲜明，腹部痞满，肢体困重，便溏尿黄，身热不扬，舌红苔黄腻，脉濡数。其证候是
A. 肝胆湿热
B. 大肠湿热
C. 肝火上炎
D. 湿热蕴脾
E. 寒湿困脾

正确答案：D。湿热蕴脾

解析：湿热蕴脾是湿热内蕴中焦所表现的证候。身目发黄，黄色鲜明，均多因湿热蕴结脾胃，熏蒸肝胆，致胆汁外溢所致；腹部痞满多因湿热阻滞中焦，纳运失健，气机阻滞所致；肢体困重，尿黄，均多因湿热交结，热蒸于内，湿泛肌肤，阻碍经气，气化不利所致；便溏多因湿热下注，阻碍气机，大肠传导失司所致；身热不扬多因湿遏热伏，郁蒸于内所致；舌红苔黄腻，脉濡数，均多因湿热内蕴所致。故为湿热蕴脾（D对）。肝胆湿热的辨证要点以胁肋胀痛、身目发黄、或阴部瘙痒、带下黄臭等与湿热症状共见为主要表现，非上述症状（A错）。大肠湿热的辨证要点以腹痛、暴泻如水、下痢脓血、大便黄稠秽臭等与湿热症状共见为主要表现，非上述症状（B错）。肝火上炎的辨证要点以头痛、烦躁、耳鸣、胁痛等与实热症状共见为主要表现，非上述症状（C错）。寒湿困脾的辨证要点以纳呆、腹胀、便溏、身重与寒湿症状共见为主要表现，非上述症状（E错）。